前庭窗后上方是
A. 鼓室盖壁
B. 面神经凸
C. 蜗窗
D. 锥隆起
E. 乳突窦

正确答案：B。面神经凸

解析：鼓室盖壁（A错）由颞骨岩部前外侧面的鼓室盖构成，分隔鼓室与颅中窝。前庭窗的后上方有一弓形隆起，称面神经管凸（B对），内藏面神经。岬的后下方有一圆形小孔，称蜗窗或圆窗（C错）。后壁为乳突壁，上部有乳突窦（E错）的入口，鼓室借此连通乳突内的乳突小房。乳突窦入口的下方有锥状突起，称锥隆起（D错）。